属于核黄素活性形式质是
A. ADP
B. FAD
C. UTP
D. NADH
E. NADPH

正确答案：B。FAD

解析：核黄素即维生素B₂，FAD（B对）是维生素B₂的活性形式（P97）。ADP（A错）即二磷酸腺苷，在生物体内通常为ATP水解的产物，不是核黄素的活性形式。UTP（C错）即三磷酸尿苷，主要用途是RNA合成或转录时的原料，不是核黄素的活性形式。NADH（D错）产生于糖酵解和三羧酸循环，在生物氧化中起到递氢和递电子的作用，不是核黄素的活性形式。NADPH（E错）是磷酸戊糖途径生成的主要产物之一，是许多合成代谢反应的供氢体、参与羟化反应以及维持谷胱甘肽的还原状态，不是核黄素的活性形式（P128）。